公民临床用血时交付的与用血有关的费用不包括
A. 血液采集费
B. 血液储存费
C. 血液检验费
D. 献血员补偿费
E. 血液分离费

正确答案：D。献血员补偿费

解析：根据《中华人民共和国献血法》规定，公民临床用血时，交付费用的项目包括：血站采集血液费用（A对）、分离血液费用（E对）、储存血液费用（B对）、检验血液费用（C对）及临床输血服务费等。《献血法》规定，无偿献血的血液必须用于临床，不得买卖，故临床用血交付费用不包括献血员补偿费（D错，为本题正确答案）。